依照《中华人民共和国药品管理法实施条例》，医疗机构购进药品，必须有
A. 真实、完整的药品购进记录
B. 符合医疗机构临床的需要
C. 药品采购部门
D. 真实、完整的药品购销记录
E. 药品采购中介组织

正确答案：A。真实、完整的药品购进记录

解析：本题考查医疗机构的药剂管理。依照《中华人民共和国药品管理法实施条例》，医疗机构购进药品，必须有真实、完整的药品购进记录（A对）。《中华人民共和国药品管理法实施条例》第四章医疗机构的药剂管理第二十六条：医疗机构购进药品，必须有真实、完整的药品购进记录。药品购进记录必须注明药品的通用名称、剂型、规格、批号、有效期、生产厂商、供货单位、购货数量、购进价格、购货日期以及国务院药品监督管理部门规定的其他内容。